某患者来院进行检查，给患者2%枸橼酸置于舌背，刺激腺体反射，如既无唾液流出，也无腺体变化和胀痛症状，说明
A. 分泌功能正常，导管无阻塞
B. 分泌功能存在，有导管阻塞
C. 分泌功能可能已经丧失
D. 不能判断腺体的分泌功能
E. 不能判断导管的通畅程度

正确答案：C。分泌功能可能已经丧失

解析：定性检查：给患者以酸性物质（临床上常以2%枸橼酸、维生素C和1%柠檬酸等置于舌背或舌缘），使腺体分泌反射性增加；根据腺体本身变化和分泌情况，判断腺体的分泌功能和导管的通畅程度。如酸刺激后导管口有大量唾液流出，说明分泌功能正常，导管也无阻塞；如导管口唾液流出量少或无唾液流出，同时腺体迅速肿大，患者述腺体胀痛，说明分泌功能存在，但有导管阻塞；如既无唾液流出，也无腺体变化和胀痛症状，说明分泌功能可能已经丧失。掌握“口外一般检查及辅助检查”知识点。